以下哪种是人工被动免疫
A. 注射菌苗
B. 口服麻痹糖丸
C. 接种卡介苗（BCG）
D. 注射免疫球蛋白
E. 注射类毒素

正确答案：D。注射免疫球蛋白